家用化学品完整的安全性评价，通常分几个阶段进行
A. 1
B. 2
C. 3
D. 4
E. 5

正确答案：E。5

解析：本题考查家用化学品完整的安全性评价的阶段。家用化学品完整的安全性评价，通常分五个阶段进行（E对ABCD错），即新产品合成设计阶段（毒性初步评估）、急性毒性试验阶段（急性毒性评价）、新产品中间试验阶段（亚急性毒性、慢性毒性、三致毒性等）、新产品正式投产阶段（中毒机制、早期诊断与治疗方案）和新产品推广使用阶段（接触人群健康状况调查）。